患者为某烧碱车间电解工段修槽工，发育良好，神志清。咽部与口腔黏膜充血，有多处点状溃疡，牙龈红肿、出血。其疾患最可能是
A. 锰中毒
B. 铅中毒
C. 砷中毒
D. 汞中毒
E. 苯中毒

正确答案：D。汞中毒